孕妇感染苍白密螺旋体首选的治疗药物是
A. 青霉素
B. 头孢曲松
C. 克林霉素
D. 氧氟沙星
E. 红霉素

正确答案：A。青霉素

解析：苍白密螺旋体为梅毒的病原体，为原核单细胞生物，具有与细菌相似的细胞壁，对青霉素（青霉素主要通过破坏细菌的细胞壁从而发挥杀菌作用）极为敏感，故孕妇感染苍白密螺旋体首选的治疗药物是青霉素（A对）。现有资料不足以推荐头孢菌素（B错）治疗孕妇梅毒和预防先天梅毒，红霉素（E错）和阿奇霉素对孕妇和胎儿梅毒感染疗效差。孕妇禁用四环素、多西环素和喹诺酮类（氧氟沙星为喹诺酮类）（D错）。克林霉素（C错）对孕妇利弊作用未明。